可产生伪膜性结肠炎的是
A. 普萘洛尔
B. 庆大霉素
C. 异丙肾上腺素
D. 林可霉素
E. 己烯雌酚

正确答案：D。林可霉素

解析：本题考查林可霉素的不良反应。林可霉素（D对）能抑制细菌的蛋白质合成，长期使用可致伪膜性肠炎。普萘洛尔（A错）严重不良反应可见急性心力衰竭、房室传导阻滞等。庆大霉素（B错）主要不良反应为肾毒性、耳毒性。异丙肾上腺素（C错）不良反应为心悸、头晕、皮肤潮红等。己烯雌酚（E错）长期大量应用可诱发生殖系统恶性肿瘤，孕期用药有致胎儿先天缺陷危险，女婴成年后发生阴道腺病或宫颈癌（DES综合征）的危险增加。